男性，24岁。反复发作性咳嗽喘息10年余，再发加重3小时。查体见意识模糊，口唇发绀，双肺呼吸音明显减低，未闻及干湿啰音，心率128次/分，可触及奇脉。为进一步明确诊断及判断病情程度最有意义的检查是
A. 痰细胞学
B. 胸部CT
C. 动脉血气分析
D. PEF占预计值百分比
E. 皮肤过敏源试验

正确答案：C。动脉血气分析

解析：患者有反复发作性咳嗽喘息，再发3小时，考虑为支气管哮喘发作。意识模糊，心率＞120次/分，有奇脉，应诊断为重度支气管哮喘急性发作。为明确诊断和判断病情程度可以行动脉血气分析（C对），若PaO₂＜60mmHg，PaCO₂＞45mmHg，诊断为哮喘重度发作。痰细胞学（A错）主要用于检查痰液中得恶性细胞以确诊肺癌。胸部CT（B错）为影像学检查，主要用于发现胸部占位性病变，不能确诊支气管哮喘。患者为支气管哮喘重度发作，不能配合PEF（最高呼气流量）检查（D错）。皮肤致敏原试验（E错）一般在确诊支气管哮喘后进行，有助于病因诊断。